患儿，男，7岁。睡中遗尿，白天小便频而量少，劳累后遗尿加重，面白气短，食欲不振，大便易溏，舌淡苔白，脉细无力。治疗除取主穴外，还应选用的是
A. 神门、阴陵泉、胃俞
B. 气海、肺俞、足三里
C. 次髎、水道、三阴交
D. 百会、神门、内关
E. 关元俞、肾俞、关元

正确答案：B。气海、肺俞、足三里

解析：该患者7岁，以睡中遗尿为主症，故诊断为遗尿。白天小便频而量少，劳累后遗尿加重，面白气短，食欲不振，大便易溏，舌淡苔白，脉细无力均为肺脾气虚之象，故辨为肺脾气虚证。神门、阴陵泉、胃俞均不能补益肺气（A错）。遗尿肺脾气虚证配肺俞、脾俞、足三里，气海能补元气（B对）。次髎、水道、三阴交用于治疗痛经（C错）。百会、神门、内关为遗尿夜梦多的配穴（D错）。关元俞、肾俞、关元用于治疗癃闭肾阳虚，且关元为癃闭的主穴（E错）。